男，40岁。出现排尿后尿道灼痛并溢出白色黏液6个月。会阴部及腰背都酸痛，性欲减退，乏力。前列腺按摩液检查：卵磷脂小体少量，白细胞20~30/HP。不应采用的治疗方法是
A. 应用活血化瘀，清热解毒的中成药
B. 热水坐浴及理疗
C. 抗菌药物治疗
D. 定期前列腺按摩
E. 抗结核治疗

正确答案：E。抗结核治疗

解析：中年男性患者，排尿后尿道灼痛，溢出白色黏液（滴白），会阴部及腰背酸痛，性欲减退，乏力。前列腺按摩液检查：卵磷脂小体少量，白细胞20~30/HP。首先考虑的疾病是慢性前列腺炎。可采用的治疗方法是应用活血化瘀，清热解毒的中成药（A对），热水坐浴及理疗（B对），抗菌药物治疗（C对），定期前列腺按摩（D对）。此患者疾病与结核无关，不应采用的治疗方法是抗结核治疗（E错，为本题正确答案）。